治疗中风中经络肝肾阴虚，风阳上扰证，应首选
A. 镇肝熄风汤
B. 天麻钩藤饮
C. 星蒌承气汤
D. 二陈汤合桃红四物汤
E. 补阳还五汤

正确答案：A。镇肝熄风汤

解析：镇肝息风汤平肝息风，育阴潜阳，治疗肝肾阴虚，肝阳偏亢，阳亢化风，气血逆乱所致的类中风（A对）。天麻钩藤饮可平肝熄风，清热活血，补益肝肾，清热安神，适用于肝阳偏亢，肝风上扰者（B错）。星蒌承气汤治疗中风之痰热腑实证（C错）。二陈汤合桃红四物汤可豁痰化瘀，通经活络，适用于中风之痰瘀互结、阻滞脉络证（D错）。补阳还五汤可益气，活血，通络，适用于中风之气虚血瘀、脉络瘀阻证（E错）。